检查青霉素钠中水分的方法是
A. 焰色反应法
B. 干燥失重测定法
C. 分子排阻色谱法
D. 红外分光光度法
E. 反相高效液相色谱法

正确答案：B。干燥失重测定法

解析：本题考查青霉素钠中水分的检查。检查青霉素钠中水分的方法是干燥失重法（B对）。